黄水疮命名的依据是
A. 部位
B. 症状
C. 形态
D. 疾病特征
E. 范围大小

正确答案：B。症状

解析：本题考查疾病的命名原则。黄水疮是一种发于皮肤有传染性的化脓性皮肤病，其脓液流溢之处又常引起新的脓疱发生，是以其症状命名的（B对）。以部位命名者，如乳痈、子痈、对口疽等（A错）。以形态命名者，如蛇头疔、鹅掌风等（C错）。以疾病特征命名者，如烂疔、流注、湿疮等（D错）。以范围大小命名者，如小者为疖，大者为痈等（E错）。